坚果的营养特点为
A. 蛋白质含量约12%～25%，属于优质蛋白质
B. 油脂含量较高，以不饱和脂肪酸为主
C. 碳水化合物的含量都很低
D. 含有大量的维生素C和硒等具有抗氧化作用的营养成分
E. 可以作为主食食用

正确答案：B。油脂含量较高，以不饱和脂肪酸为主

解析：本题考查坚果的营养特点。坚果中油脂含量可高达44%～70%，以不饱和脂肪酸为主（B对）。坚果的蛋白质含量约12%～25%，但坚果中有些必需氨基酸相对较低，从而影响蛋白质的生物学价值（A错），如核桃蛋白质蛋氨酸和赖氨酸含量不足。坚果的碳水化合物含量依不同种类而异，含量较高的如栗子为77.2%，其他较低，如核桃为9.6%、榛子为14.7%（C错）。坚果中的矿物质比较丰富，含有大量的维生素E和硒等具有抗氧化作用的营养成分（D错）。坚果的特点是高热量高脂肪，不可以作为主食食用（E错）。